下列方剂中羌活、独活同用的是
A. 羌活胜湿汤、败毒散
B. 仙方活命饮、济川煎
C. 龙胆泻肝汤、黄龙汤
D. 逍遥散、参苓白术散
E. 羚角钩藤汤、小柴胡汤

正确答案：A。羌活胜湿汤、败毒散

解析：羌活胜湿汤组成羌活、独活、藁本、防风、甘草、蔓荆子、川芎。败毒散组成柴胡、甘草、桔梗、人参、川芎、茯苓、枳壳、前胡、羌活、独活。羌活胜湿汤方歌：羌活胜湿羌独芎，甘蔓藁本与防风，湿气在表头腰重，发汗升阳有异功。败毒散方歌：人参败毒茯苓草，枳桔柴前羌独芎，薄荷少许姜三片，实行感冒有奇功。故二者均同用羌活、独活（A对）。